“梅花K”黄柏胶囊事件中，造成范可尼综合征的是
A. 四环素
B. 氯霉素
C. 链霉素
D. 庆大霉素
E. 黄连素

正确答案：A。四环素